治疗实水一身悉肿，腹胀喘满，二便不利，脉沉实有力者，应首选
A. 五苓散
B. 五皮散
C. 实脾散
D. 真武汤
E. 十枣汤

正确答案：E。十枣汤

解析：治疗实水一身悉肿，腹胀喘满，二便不利，脉沉实有力者。方用十枣汤。为泻下逐水的代表方。是治疗悬饮及阳水实证的基础方。甘遂善行经隧水湿，大戟泄脏腑水湿，芫花消胸胁伏饮痰癖，大枣缓和诸药毒性、益气护胃，减少药后反应、培土制水，邪正兼顾（E对）。五苓散为利水化气之剂（A错）。五皮散为治皮水之常用方（B错）。实脾散为治疗脾肾阳虚水肿之常用方（C错）。真武汤为温阳利水之基础方（D错）。记忆：十枣逐水效甚夸，大戟甘遂与芫花，悬饮内停胸胁在，水肿腹胀用无差。